精神分裂症与预后不良有关的因素是
A. 已婚
B. 急性或亚急性起病
C. 以阴性症状为主
D. 初发时年龄晚
E. 文化程度高

正确答案：C。以阴性症状为主

解析：精神分裂症以阴性症状为主为预后不良的重要预测因子（C对）。已婚、急性或亚急性起病、初发时年龄晚、文化程度高都不是预后不良因素（ABDE错）。